主要含甾体皂苷类的中药是
A. 麦冬
B. 甘草
C. 商陆
D. 罗布麻叶
E. 合欢皮

正确答案：A。麦冬

解析：本题考查的是麦冬的化学成分。主要含甾体皂苷类的中药是麦冬（A对）。麦冬含有甾体皂苷，《中国药典》以鲁斯可皂苷元为对照品，测定麦冬总皂苷的含量，要求含量不得少于0.12%。甘草（B错）所含的三萜皂苷以甘草皂苷含量最高。甘草皂苷又称甘草酸，为甘草中的甜味成分。《中国药典》以甘草苷和甘草酸为指标成分，控制甘草和炙甘草的质量，其中甘草苷为黄酮苷，并要求甘草和炙甘草的甘草苷含量均不得少于0.50%，甘草中甘草酸的含量不得少于2.0%，炙甘草中甘草酸的含量不得少于1.0%。商陆（C错）的化学成分主要包括三萜及其皂苷类，其中包括商陆皂苷等。《中国药典》以商陆皂苷甲（商陆皂苷A）为指标成分进行含量测定，含量不得少于0.15%。罗布麻叶（D错）中主要强心苷及其化学结构：罗布麻叶中所含强心苷主要是甲型强心苷。合欢皮（E错）合欢皮极性部分的主要成分是三萜皂苷。《中国药典》以（-）-丁香树脂酚-4-O-β-D-呋喃芹糖基-（1→2）-β-D-吡喃葡萄糖苷为指标成分进行含量测定。